经典的毒理学研究的对象是
A. 核素
B. 微波
C. 细菌
D. 病毒
E. 各种化学物质

正确答案：E。各种化学物质